第二信使不包括
A. PIP2
B. cAMP
C. 甘油二酯
D. Ca2+
E. 三磷酸肌醇

正确答案：A。PIP2

解析：第一信使与细胞膜上特异受体结合后，在胞质内产生的细胞内信号分子，如cAMP、Ca2+、三磷酸肌醇、甘油二酯、神经酰胺、NO、CO等称为第二信使，它们能诱导细胞产生一系列生物学效应。掌握“各信号分子及转导机制”知识点。